根据临床治疗需要既可炒焦又可麸炒的中药是
A. 山药
B. 枳实
C. 骨碎补
D. 山楂
E. 苍术

正确答案：E。苍术

解析：本题考查的是苍术的炮制方法。根据临床治疗需要既可炒焦又可麸炒的中药是苍术（E对）。苍术：【炮制方法】处方用名有苍术、茅苍术、炒苍术、焦苍术。①苍术；②麸炒苍术；③焦苍术。山药（A错）：【炮制方法】处方用名有山药、怀山药、土炒山药、炒山药。①山药；②土炒山药；③麸炒山药。枳实（B错）可采用麸炒炮制，以缓和药性。骨碎补（C错）：【炮制方法】处方用名有骨碎补、申姜、制骨碎补、烫骨碎补。①骨碎补；②砂炒骨碎补。山楂（D错）：【炮制方法】处方用名有山楂、炒山楂、焦山楂、焦楂、山楂炭。①山楂；②炒山楂；③焦山楂；④山楂炭。